药剂制备过程中，可能污染微生物的因素有
A. 原药材
B. 药剂辅料
C. 制药设备
D. 包装材料
E. 操作人员

正确答案：A、B、C、D、E。原药材；药剂辅料；制药设备；包装材料；操作人员